位于声门裂平面至环状软骨下缘之间
A. 喉前庭
B. 喉中间腔
C. 声门下腔
D. 声门裂
E. 前庭裂

正确答案：C。声门下腔

解析：声门下腔位于声门裂平面至环状软骨下缘之间（C对）。